龟甲主治
A. 阴虚消渴
B. 肺虚久咳
C. 须发早白
D. 阴虚动风
E. 肺热咳嗽

正确答案：D。阴虚动风

解析：本题考查的是龟甲的主治病证。龟甲主治阴虚动风（D对）。龟甲：【功效】滋阴潜阳，益肾健骨，养血补心，凉血止血。天冬：【主治病证】（1）肺热燥咳，顿咳痰黏，劳嗽咯血。（2）骨蒸潮热，津伤口渴，阴虚消渴（A错）。（3）肠燥便秘。百合：【主治病证】（1）肺虚久咳（B错），阴虚燥咳，劳嗽咯血。（2）虚烦惊悸，失眠多梦，精神恍惚。墨旱莲：【主治病证】（1）肝肾阴虚之头晕目眩、须发早白（C错）。（2）阴虚血热之吐血、衄血、尿血、便血、崩漏。牛蒡子：【主治病证】（1）风热感冒，温病初起。（2）风热或肺热咳嗽（E错）、咯痰不畅，咽喉肿痛。（3）麻疹不透，风热疹痒。（4）热毒疮肿，痄腮。